口腔扁平苔藓发病可能与以下因素有关的是
A. 吸烟、外伤、心理因素
B. 遗传、吸烟酗酒、细菌感染
C. 心理因素、吸烟、不良修复体
D. 内分泌因素、病毒感染、自身免疫
E. 心理因素、不良修复体、内分泌因素

正确答案：D。内分泌因素、病毒感染、自身免疫

解析：本题考查口腔扁平苔藓的病因。口腔扁平苔藓发病可能与以下因素有关的是内分泌因素、病毒感染、自身免疫（D对）。口腔扁平苔藓（0LP）是一种常见口腔黏膜慢性炎性疾病，是口腔黏膜病中仅次于复发性阿弗他溃疡的常见疾病。0LP的病因和发病机制目前尚不明确。临床和基础研究结果显示，可能与多种致病因素有关，如免疫因素、精神因素、内分泌因素、感染因素、微循环障碍、遗传因素、系统性疾病以及口腔局部刺激因素等。其中，细胞介导的局部免疫应答紊乱在OLP的发生发展中具有重要作用。